心与肝的关系主要体现在哪方面
A. 精血同源与藏泻互用
B. 血液生成与津液运行
C. 气的生成与津液代谢
D. 血液运行与精神情志
E. 水火既济与精神互用

正确答案：D。血液运行与精神情志

解析：心藏神，主精神活动；肝主疏泄，调畅情志，两者协调，维持正常的精神情志活动。心血充足，心神清明，有助于肝主疏泄；肝气条达，肝血充盈，有助于心神内守，两者相互为用，则精神饱满，情志舒畅（D对）。“精血同源与藏泻互用”是肝与肾的关系（A错）。“气的生成与津液代谢”是肺与脾的关系（C错）。“水火既济与精神互用”是心与肾的关系（E错）。